米非司酮治疗子宫肌瘤的每日的用量为
A. 5mg
B. 7.5mg
C. 10mg
D. 12.5mg
E. 18mg

正确答案：D。12.5mg

解析：米非司酮：每日12.5mg口服，可作为术前用药或提前绝经用。因有增加子宫内膜增生的风险，不可长期使用。掌握“子宫肌瘤”知识点。